0.12%或0.2%氯己定液含漱的正确使用方法是
A. 每天1次，每次10ml，每次1分钟
B. 每天1次，每次20ml，每次1分钟
C. 每天2次，每次10ml，每次1分钟
D. 每天2次，每次20ml，每次1分钟
E. 每天3次，每次10ml，每次1分钟

正确答案：C。每天2次，每次10ml，每次1分钟

解析：使用0.12%或0.2%氯己定液含漱，每天2次，每次10ml，每次1分钟，可抑制菌斑形成达45%～61%，牙龈炎可减少27%～67%。除了抗菌斑与龈炎外，还可用于口内手术之后，预防根面龋及龈下冲洗。当与氟化亚锡一起用于预防项目时，应在用氯己定液含漱后30～60分钟再用氟化亚锡，以防止作用相互抵消。掌握“菌斑控制及提高宿主抵抗力”知识点。